tRNA反密码第1位上的I与mRNA密码第3位上的A、C、U均可配对，属于
A. 摆动性
B. 通用性
C. 连续性
D. 简并性
E. 特异性

正确答案：A。摆动性